医疗保健机构依法开展产前诊断的，必须符合卫健委规定的条件和技术标准，并经县级以上地方人民政府卫生行政部门
A. 审查
B. 审核
C. 认可
D. 许可
E. 确认

正确答案：D。许可